关于前臂双骨折的治疗，下列说法哪项是错误的
A. 应注意防止畸形和旋转
B. 发生在上1/3的骨折先复位尺骨
C. 先复位稳定的骨折，再复位不稳定的骨折
D. 术后2周开始手指屈伸和前臂旋转
E. 发生在中段的骨折，一般先复位尺骨

正确答案：D。术后2周开始手指屈伸和前臂旋转

解析：前臂双骨折可发生多种移位，故治疗除良好的对位、对线以外，需特别注意防止畸形和旋转（A对）。术后2周开始练习手指屈伸活动和腕关节活动，4周后开始练习肘、肩关节活动，8～10周后拍片证实骨折已愈合，才可进行前臂旋转活动（D错，为本题正确答案）。手法复位时，先复位稳定的骨折，后复位不稳定骨折（C对）；尺、桡骨不稳定型骨折，发生在上1/3时，先复位尺骨（B对），发生在下1/3时，先复位桡骨，发生在中段时，一般先复位尺骨（E对）。